下列属于输注血小板禁忌证的是
A. 骨髓造血功能衰竭
B. 血小板功能障碍
C. 血小板减少患者术前输注血小板
D. 血栓性血小板减少性紫癜
E. 大量输血所致的稀释性血小板减少

正确答案：D。血栓性血小板减少性紫癜

解析：输注血小板禁忌证有血栓性血小板减少性紫癜（TTP）（D对）、肝素诱发的血小板减少等。血栓性血小板减少性紫癜患者血管性血友病因子裂解酶（vWF-cp）缺乏或活性降低，不能正常降解超大分子vWF（UL-vWF），聚集的UL-vWF促进血小板黏附聚集，在微血管内形成血小板血栓，而输注血小板会加重血栓形成，其治疗应首选新鲜血浆置换。骨髓造血功能衰竭（A错）、血小板功能障碍（B错）、血小板减少患者术前输注血小板（C错）、大量输血所致的稀释性血小板减少（E错）均可输注血小板纠正血小板减少引起的出血，改善症状。